男，50岁，1周来右侧后牙咬物不适，冷水引起疼痛。近4日来，夜痛影响睡眠，并引起半侧头、面部痛，痛不能定位。检查时见右侧上、下第一磨牙均有咬合面龋洞。为确定牙位进行的一项检查是温度测试。患牙的诊断最可能是急性牙髓炎。如经检查后不能确定患牙的颌位，应作
A. 咬诊
B. 麻醉测试
C. 温度测验
D. 牙周袋探诊
E. X线片检查

正确答案：B。麻醉测试

解析：本题考查牙髓病的明确诊断。麻醉测试（B对）是判定患牙位置的最后方法。咬诊（A错）不能定位患牙。温度测试（C错）已经定位患牙失败，不能再用。牙周袋探诊（D错）是用来了解牙周支持组织的丧失状况，探测整个牙列所有牙齿的每个牙面有无牙周袋的形成、牙周袋的深度、牙周附着水平，而不能用于确定患牙的颌位。X线片检查（E错）可以发现龋坏的牙齿，但并不能定位引起疼痛的患牙。